男，50岁，高热，全身酸痛，咳嗽2天入院，咳少量脓痰，既往体健，查体：T39.8℃，P69次/分，R30次/分，BP90/60mmHg，口唇发绀，双下肺可闻及湿啰音，血WBC12.8×10⁹/L，N0.85，胸部X线片示双下肺斑片状阴影，无空洞，右侧少量胸腔积液，血气分析是Ⅰ型呼吸衰竭。考虑治疗方案时，应特别注意覆盖的病原体是
A. 肺炎链球菌
B. 金黄色葡萄球菌
C. 病毒
D. 革兰阴性杆菌
E. 军团菌

正确答案：E。军团菌

解析：患者高热、咳嗽、咳痰，肌痛、相对缓脉，胸部X线片示双下肺斑片状阴影，无空洞。最可能的诊断为军团菌肺炎（E对）。肺炎链球菌（A错）寒战、高热、咳铁锈色痰、胸痛，X线示肺叶或肺段实变，无空洞，可伴胸腔积液。金黄色葡萄球菌（B错）寒战、高热、脓血痰、气急、毒血症症状、休克，X线示肺叶或小叶浸润，早期空洞，脓胸，可见液气囊腔。病毒性肺炎（C错）胸部X线检查可见肺纹理增多，磨玻璃状阴影。